某患者牙列缺失15年，牙槽嵴严重吸收，修复宜选用哪种人工牙
A. 解剖式牙
B. 半解剖式牙
C. 非解剖式牙
D. 金属（牙合）面牙
E. 瓷牙

正确答案：C。非解剖式牙

解析：非解剖式牙：人工（牙合）面形态与天然牙不同，仅有窝沟而无牙尖，称为无尖牙。上下后（牙合）面为平面接触。非解剖式牙的侧向力小，有利于义齿的稳定和支持组织的健康，而且正中（牙合）咬合时有较大的自由度，适用于上下颌骨关系异常，或牙槽嵴条件较差者。但咀嚼效能和美观效果一般不如解剖式牙。掌握“全口义齿排牙及蜡型试戴”知识点。